男，18岁。寒战、高热、咳嗽4天。1周前脚趾曾划伤化脓感染，经治疗后愈合。听诊双肺可闻及湿啰音，血常规WBC17×10⁹/L，N0.92，胸部X线片示两肺多发性块状密度增高影，部分有空洞形成。最可能的诊断是
A. 肺血管炎
B. 肺结核
C. 肺囊肿继发感染
D. 肺脓肿
E. 真菌性肺炎

正确答案：D。肺脓肿

解析：患者为青年男性，寒战、高热、咳嗽，脚趾有划伤（提示前驱感染史），WBC17×10⁹/L（正常值为4～10×10⁹/L），N0.92（正常值为0.50～0.75），提示存在感染，胸部X线片示两肺多发性块状密度增高影，部分有空洞形成（为肺脓肿的典型胸片改变），考虑诊断为肺脓肿（D对），且该病例的肺脓肿类型最可能为血源性肺脓肿，血源性肺脓肿常因皮肤外伤感染（该病例1周前脚趾曾划伤化脓感染）、疖、痈、中耳炎或骨髓炎等所致的脓毒症，菌栓经血行播散到肺，引起小血管栓塞、炎症和坏死而形成肺脓肿（P58）。肺血管炎（A错）肺血管炎的全身症状包括发热、乏力、关节痛和皮损等。肺结核（B错）（P65）起病缓慢，病程较长，有低热盗汗等结核毒血症状，影像特点是病变多发生在上叶的尖后段、下叶的背段和后基底段，呈多态性改变。肺囊肿（C错）X线多为液气囊腔，内有液面，与本病X线变现不同。真菌性肺炎（E错）（P54）具有支气管肺炎的各种症状和体征，但起病缓慢，多在大量应用抗生素、糖皮质激素时出现或加剧，可有发热，咳嗽剧烈，痰为无色胶冻样，偶带血丝，肺部听诊可有中小水泡音，X线胸片示大片状阴影，多见肺底和中部，个别为粟粒状阴影，但在短期内可有变化。